下列各项，不属有机磷农药中毒治疗中“阿托品化”临床表现的是
A. 瞳孔较前扩大
B. 心率加快
C. 流涎加重
D. 颜面潮红
E. 肺部湿啰音消失

正确答案：C。流涎加重

解析：“阿托品化”的指征为口干（而非流涎加重）（C错，为本题正确答案）、皮肤干燥、面部潮红（D对）、心率增快（B对）、肺部湿啰音消失（E对）及瞳孔较前扩大（A对）。如出现瞳孔明显扩大、神志模糊、烦躁不安、抽搐、昏迷和尿潴留等，为阿托品中毒，应立即停用阿托品。